下列属于口腔癌控制危险因素的是
A. 戒除吸烟、饮酒、嚼槟榔等不良嗜好
B. 注意对光辐射的防护，避免长时间直接日照
C. 不食过热食品，避免刺激口腔黏膜组织
D. 避免口腔不良刺激
E. 以上都是

正确答案：E。以上都是

解析：控制危险因素：①戒除吸烟、饮酒、嚼槟榔等不良嗜好；②注意对光辐射的防护，避免长时间直接日照；③不食过热食品，避免刺激口腔黏膜组织；④避免口腔不良刺激。及时调磨尖锐牙尖和义齿锐利边缘，防止对软组织反复刺激，并保持良好的口腔卫生。掌握“口腔癌的预防”知识点。